女，45岁，四肢无力，站立不稳，进行性加重半年，无外伤史。查体：双下肢肌张力高腱反射亢进。Hoffmann征（+），Babinski征（+）。应首先选择的治疗方法是
A. 理疗
B. 手术治疗
C. 推拿按摩
D. 颏枕带牵引
E. 带围领和颈托

正确答案：B。手术治疗

解析：患者四肢无力、站立不稳、进行性加重半年（脊髓型颈椎病典型表现），无外伤史，双下肢肌张力高、腱反射亢进、Hoffmann征（+）、Babinski征（+）（脊髓型颈椎病典型体征），结合患者症状、体征，应诊断为脊髓型颈椎病。由于本型疾病自然史为症状逐渐发展加重，故应首先选择的治疗方法是手术治疗（B对）。理疗（A错）、推拿按摩（C错）、颏枕带牵引（D错）、带围领和颈托（E错）等非手术治疗主要用于神经根型、椎动脉型和交感神经型颈椎病的治疗。